女性，44岁，反复发作上腹部疼痛3年，近3天上腹绞痛，伴发热寒颤，皮肤巩膜黄染。该病最可能的原因是
A. 肿瘤
B. 结石
C. 蛔虫
D. 炎性狭窄
E. 先天畸形

正确答案：B。结石

解析：中年女性，3天来腹痛、寒战高热、黄疸（Charcot三联征，继发胆管炎典型表现），根据临床表现及病史，可诊断为继发性胆管炎。该病最可能的原因是结石（B对）。胆道肿瘤（A错）疼痛一般不是绞痛、无寒颤发热。胆道蛔虫（C错）有钻顶样疼痛，且一般无黄疸或黄疸较轻。炎性狭窄（D错）虽以反复发作的胆管炎为表现，但其较胆石症少见，不应首先考虑此病。先天畸形（E对）多有肝脾大、腹部肿块等表现，且多在少年时发病。